某男，65岁。耳中如蝉鸣，时作时止，按之鸣声减弱，听力亦下降，同时伴神疲乏力，食少腹胀，便溏，脉细弱。治疗宜在听宫、翳风、太溪、肾俞基础上，加用
A. 行间丘墟
B. 外关合谷
C. 丰隆阴陵泉
D. 气海足三里
E. 肾俞肝俞

正确答案：D。气海足三里

解析：患者耳中如蝉鸣，时作时止，按之鸣声减弱，听力亦下降，脉细弱，诊为耳鸣之虚证。神疲乏力，食少腹胀，便溏为气虚之象。为脾虚运化不利，精微不足濡养耳窍，气虚推动无力，无以上荣耳窍所致。主穴选用听宫、翳风、太溪、肾俞，补肾养窍。配穴选用足三里和气海，补中益气（D对）。